弥漫性新月体性肾小球肾炎因肾小球囊内新月体形成，阻塞囊腔，患者可迅速出现的异常情况是
A. 蛋白尿
B. 血尿
C. 少尿
D. 管型尿
E. 乳糜尿

正确答案：C。少尿

解析：弥漫性新月体性肾小球肾炎由于新月体的形成。阻塞囊腔，通常会使患者迅速出现少尿等症状（C对）。蛋白尿通常由于肾小球滤过膜受损和肾小管重吸收功能降低所致（A错）。血尿一般由于肾小球滤过功能膜受损所导致（B错）。管型尿主要由于蛋白质、细胞或碎片在肾小管和集合管中凝固而成（八版诊断学P315），一般是肾小管功能受损导致，与新月体对肾小球的影响无关（D错）。乳糜尿常见于丝虫病和肾周围淋巴管梗阻，新月体的形成不影响肾周围淋巴管，因此不会出现乳糜尿（E错）。